选择血管活性药物治疗休克时应首先
A. 充分补足血容量
B. 保护和改善细胞功能
C. 纠正酸中毒
D. 改善心脏功能
E. 去除原发病因

正确答案：A。充分补足血容量

解析：选择血管活性药物治疗休克时应根据实际情况使用,在休克淤血期应补足血容量后（A对BCDE错）使用，目的是提高微循环灌流量。在微循环缺血期要强调尽早和尽快补充血容量，以降低交感－肾上腺髓质系统兴奋性，减少儿茶酚胺释放量，缓解微循环前阻力血管收缩程度，提高微循环灌流量，防止休克加重。